下列哪项不是学校健康教育的目标
A. 提高学生健康知识水平
B. 改变学生健康认知态度
C. 建立学生健康行为习惯
D. 提高学生的学习技巧
E. 提高学生的健康水平

正确答案：D。提高学生的学习技巧